依据《互联网药品交易服务审批（试行）》规定，关于互联网药品交易说法错误的是
A. 提供互联网交易服务的企业必须严格审核参与互联网交易的药品的合法性
B. 向个人消费者提供互联网交易服务的企业可以网上销售本企业经营的全部药品
C. 通过自身网站与本企业成员之外的其他企业进行互联网交易的药品生产企业只能交易本企业生产的药品
D. 通过自身网站进行互联网药品交易服务的药品经营企业不得利用自身网站提供其他互联网交易服务
E. 提供互联网药品交易服务的企业必须审核交易双方的资格证明文件并备案

正确答案：B。向个人消费者提供互联网交易服务的企业可以网上销售本企业经营的全部药品

解析：本题考查互联网药品交易服务管理。向个人消费者提供互联网药品交易服务的企业只能在网上销售本企业经营的非处方药（B错，为本题正确答案）。《互联网药品交易服务审批暂行规定》第十八条：提供互联网药品交易服务的企业必须在其网站首页显著位置标明互联网药品交易服务机构资格证书号码。第十九条：提供互联网药品交易服务的企业必须严格审核参与互联网药品交易的药品生产企业、药品经营企业、医疗机构从事药品交易的资格及其交易药品的合法性（A对）。对首次上网交易的药品生产企业、药品经营企业、医疗机构以及药品，提供互联网药品交易服务的企业必须索取、审核交易各方的资格证明文件和药品批准证明文件并进行备案（E对）。第二十条：通过自身网站与本企业成员之外的其他企业进行互联网药品交易的药品生产企业和药品批发企业只能交易本企业生产或者本企业经营的药品（C对），不得利用自身网站提供其他互联网药品交易服务（D对）。第二十一条：向个人消费者提供互联网药品交易服务的企业只能在网上销售本企业经营的非处方药，不得向其他企业或者医疗机构销售药品。第二十二条：在互联网上进行药品交易的药品生产企业、药品经营企业和医疗机构必须通过经（食品）药品监督管理部门和电信业务主管部门审核同意的互联网药品交易服务企业进行交易。参与互联网药品交易的医疗机构只能购买药品，不得上网销售药品。第二十八条：未取得互联网药品交易服务机构资格证书，擅自从事互联网药品交易服务或者互联网药品交易服务机构资格证书超出有效期的，（食品）药品监督管理部门责令限期改正，给予警告；情节严重的，移交信息产业主管部门等有关部门依照有关法律、法规规定予以处罚。